骨巨细胞瘤的好发年龄是
A. 1～5岁
B. 6～10岁
C. 11～15岁
D. 16～20岁
E. 21～30岁

正确答案：E。21～30岁

解析：识记内容。骨巨细胞瘤的好发年龄是20～40岁（E对）。